乳腺癌患者乳腺皮肤出现“酒窝征”的原因
A. 肿瘤侵犯了腰大肌
B. 肿瘤侵犯了Cooper韧带
C. 癌细胞堵塞了局部皮下淋巴管
D. 肿瘤侵犯周围腺体
E. 肿瘤侵犯了局部皮肤

正确答案：B。肿瘤侵犯了Cooper韧带

解析：胸壁浅筋膜发出许多小的纤维束，向深面连于胸筋膜，在浅面连于皮肤，对乳房起支持和固定作用，称为乳房悬韧带或Cooper韧带。肿瘤侵犯了Cooper韧带（B对）可使其缩短，牵引皮肤凹陷，出现“酒窝征”。肿瘤侵犯了胸大肌（A错）可使癌块底部固定于胸壁而不易推动。癌细胞堵塞了局部皮下淋巴管（C错）可引起淋巴回流障碍，出现真皮水肿，皮肤呈“橘皮样”改变。肿瘤侵犯周围腺体（D错），癌细胞广泛分布于乳腺各个小叶中，引起局部巨大癌块。肿瘤侵犯了局部皮肤（E错），可在周围形成许多小结节，称为卫星结节。